溃疡性结肠炎活动期的重要表现是
A. 发热
B. 腹痛
C. 腹部压痛
D. 粘液脓血便
E. 贫血

正确答案：D。粘液脓血便

解析：溃疡性结肠炎活动期的重要表现是粘液脓血便（D对）。在活动期，结肠固有膜内存在弥漫性淋巴细胞、浆细胞、单核细胞等细胞浸润，黏膜因此而糜烂、溃疡，最终出现黏液脓血便，相较发热（A错）、腹痛（B错）、腹部压痛（D错）和贫血（E错）等而言，其具有一定的特征性、可更直观地反映病情活动性。